临证运用枳实导滞丸的辩证要点是
A. 脘腹胀满，嗳腐厌食，苔厚腻，脉滑
B. 脘腹胀满，大便失常，苔黄腻，脉沉有力
C. 脘腹痞闷，食少难消，大便溏薄，苔腻微黄，脉虚弱
D. 心下痞满，食少倦怠，苔腻微黄
E. 眩晕呕吐，胸膈痞闷，食少体倦，小便不利

正确答案：B。脘腹胀满，大便失常，苔黄腻，脉沉有力

解析：枳实导滞丸为治疗湿热食积证之常用方。方中君以大黄攻积泻热，使积热从大便而下；臣以枳实行气消积，而除脘腹之胀满；佐以黄连、黄芩清热燥湿，又能厚肠止痢；以茯苓、泽泻利水渗湿，且可止泻；用白术健脾燥湿，以攻积而不伤正；神曲消食化滞，使食消而脾胃和。诸药相伍，使积去滞消，湿化热清，则诸证自解。故临床以脘腹胀满，大便失常，苔黄腻，脉沉有力为辨证要点（B对）。